一面颊部切割伤患者因伤后很长时间才就诊，出血较多，有休克症状时，应采取的根本措施是
A. 安静
B. 补充血容量
C. 镇静
D. 清创缝合
E. 防止感染

正确答案：B。补充血容量

解析：本题考查抗休克治疗。失血性休克应以补充血容量（B对）、彻底消除出血原因，制止血容量继续丢失来恢复组织灌流量，维持生命体征。安静（A错）、镇静（C错）为辅助措施。清创缝合（D错）为创口处理原则，患者受外伤时，在全身状况基本稳定后应尽早清创缝合，防止感染（E错）。